符合良性高血压血管病变的是
A. 小动脉外膜纤维增生
B. 小动脉玻璃样变性
C. 细动脉胶原纤维增生
D. 细动脉平滑肌增生
E. 细动脉玻璃样变性

正确答案：E。细动脉玻璃样变性

解析：良性高血压按病变的发展分为三期：功能紊乱期、动脉病变期和内脏病变期。动脉病变期包括细小动脉硬化，它是高血压病的主要病变特征，表现为细小动脉玻璃样变（E对）。细小动脉玻璃样变最易累及肾的入球动脉、视网膜动脉和脾的中心动脉。由于细小动脉因长期痉挛，加之血管内皮细胞受长期的高血压刺激，使内皮细胞及基底膜受损，内皮细胞间隙扩大，通透性增强，血浆蛋白渗入血管壁中。同时SMC分泌大量细胞外基质，SMC因缺氧而变性、坏死，遂使血管壁逐渐由血浆蛋白、细胞外基质和坏死的SMC产生的修复性胶原纤维及蛋白多糖所代替，正常结构消失，逐渐凝固成红染无结构的玻璃样物质，致细动脉壁增厚，管腔缩小甚至闭塞。恶性高血压亦称急进型高血压，多见于青少年，血压显著增高，常超过230/130mmHg，病变进展迅速，可发生高血压脑病，或较早就出现肾衰竭，或常出现视网膜出血及视盘水肿。特征性的病变是增生性小动脉硬化（D错）和坏死性细动脉炎，主要累及肾（P142）。